引起心肌细胞坏死的最常见原因是
A. 动脉血压突然升高
B. 急性心肌梗死
C. 容量负荷过重
D. 严重贫血
E. 甲状腺机能亢进

正确答案：B。急性心肌梗死

解析：急性心肌梗死（B对）时，心肌细胞严重缺血缺氧，继而变性坏死，引起心肌收缩功能降低。长期容量负荷过重（C错）、严重贫血（D错）时，心肌细胞慢性缺血缺氧，心肌能量代谢障碍，引起心肌收缩功能降低。